阻断AT₁受体而用于治疗各型高血压的药物是
A. 氯沙坦
B. 呋塞米
C. 可乐定
D. 肼屈嗪
E. 硝普钠

正确答案：A。氯沙坦

解析：本题考查氯沙坦。氯沙坦（A对）是第一个临床应用口服有效的非肽类AT₁受体阻断药。通过拮抗AT₁受体，松弛平滑肌，对抗醛固酮分泌，减少水钠潴留，阻止成纤维细胞的增殖和内皮细胞凋亡，从而起到降压作用。呋塞米（B错）为强效利尿药，降压机制是：早期通过排钠利尿，使血容量减少而降压；长期用药所致的降压效应与小动脉扩张有关。可乐定（C错）属于中枢性降压药，能够抑制中枢神经，降低血压。肼屈嗪（D错）和硝普钠（E错）同属NO供体药物，在血管平滑肌内代谢产生NO，能够直接松弛小动脉和静脉平滑肌而降压。